患者，女，60岁，患有高血压、冠心病，医师处方硝酸甘油片备用。关于该患者用药教育的说法，错误的是
A. 用药后可能出现心率加快
B. 心绞痛发作时立刻嚼碎吞服
C. 心绞痛发作时，首次使用后若症状未缓解，可每5分钟用药1次
D. 心绞痛发作时，每次给药0.5mg，15分钟内给药最多不超过3次
E. 药品需遮光、密封、在阴凉处保存

正确答案：B。心绞痛发作时立刻嚼碎吞服

解析：本题考查硝酸甘油的患者用药教育。硝酸酯类药物会反射性增加交感神经张力，使心率加快（A对）。常联合负性心率药物如体阻断剂或非二氢吡啶类CCB（如地尔硫䓬等）治疗慢性稳定型心绞痛。舌下含服硝酸甘油可作为心绞痛发作时缓解症状用药（B错，为本题正确答案），每次0.25～0.5mg， 每5分钟含服1次（C对），直至症状缓解，15分钟内含服最大剂量不超过1.5mg（D对）。硝酸甘油易受光线影响而变质，需遮光、密封、在阴凉处保存（E对）。